流行性脑脊髓膜炎，病理变化为
A. 变质性炎
B. 化脓性炎
C. 增生性炎
D. 出血性炎
E. 假膜性炎

正确答案：B。化脓性炎

解析：流行性脑脊髓膜炎简称为流脑，是由脑膜炎奈瑟菌引起的急性化脓性脑膜炎。其主要临床表现是突发高热、剧烈头痛、频繁呕吐，皮肤黏膜瘀点、瘀斑及脑膜刺激征（B对），严重者可有败血症休克和脑实质损害，常可危及生命。部分患者暴发起病，可迅速致死。本病经呼吸道传播，冬春季多见。全球分布，呈散发或流行，儿童发病率高。